男，25岁。低热、咳嗽、咽部不适2周。胸部X线示双肺下部网状及按小叶分布的斑片状浸润阴影。最可能感染的病原体是
A. 流感嗜血杆菌
B. 肺炎链球菌肺炎
C. 肺炎克雷伯杆菌
D. 铜绿假单胞菌肺炎
E. 肺炎支原体

正确答案：E。肺炎支原体

解析：患者为少年男性，低热、咳嗽、咽部不适2周，胸部X线片示两肺下部网状及按小叶分布的斑片状浸润阴影（为支原体肺炎的典型胸片改变），血WBC10×10⁹/L（正常值4～10×10⁹/L）略增高，根据其临床表现和辅助检查，可诊断为支原体肺炎（E对）。肺炎球菌肺炎（P46）（B错）多有上呼吸道感染的前驱症状，起病急骤，高热、寒战，全身肌肉酸痛等，X线有肺实变体征等，本例病无上感的前驱症状，且是低热。